某男，44岁。患肾虚精亏，阳痿不育、遗精早泄、腰痛、尿后余沥。宜选用的中成药是
A. 济生肾气丸
B. 五子衍宗丸
C. 右归丸
D. 桂附地黄丸
E. 青娥丸

正确答案：B。五子衍宗丸

解析：本题考查五子衍宗丸的主治。宜选用的中成药是五子衍宗丸（B对）。五子衍宗丸（片、口服液）【主治】肾虚精亏所致的阳痿不育、遗精早泄、腰痛、尿后余沥。济生肾气丸（A错）（片）【主治】肾阳不足、水湿内停所致的肾虚水肿、腰膝酸重、小便不利、痰饮咳喘。右归丸（C错）（胶囊）【主治】肾阳不足，命门火衰，腰膝酸冷，精神不振，怯寒畏冷，阳痿遗精，大便溏薄，尿频而清。桂附地黄丸（D错）【主治】肾阳不足，腰膝酸冷，肢体浮肿，小便不利或反多，痰饮喘咳，消渴。青蛾丸（E错）【主治】肾虚腰痛，起坐不利，膝软乏力。